患者因左侧牙冷热痛就诊。查：左下6度重度磨损不均匀，未探及穿髓孔，热测引起疼痛并持续2分钟，叩（-），该患牙处理原则为
A. 嘱患者少食硬食
B. 脱敏
C. 调（牙合）
D. 牙髓治疗
E. 全冠修复

正确答案：D。牙髓治疗

解析：本题考查不可复性牙髓炎的治疗。患者因左侧牙冷热痛就诊。查：左下6度重度磨损不均匀，未探及穿髓孔，热测引起疼痛并持续2分钟，叩（-），该患牙处理原则为牙髓治疗（D对）。根据病例描述热测结果，可考虑患牙已有不可复性牙髓炎，则患牙的处理原则为牙髓治疗。患牙重度磨损不均匀，应嘱患者少食硬食（A错），减少牙齿的磨损，此为医嘱的内容，不属于治疗原则。脱敏（B错）适用于患牙磨损，牙本质暴露，有牙本质敏感症状时，病例中的患牙已呈不可复性牙髓炎表现，并不是牙本质敏感，故不需脱敏治疗。调（牙合）（C错）适用于患牙因磨损导致接触关系不良，引起食物嵌塞的情况，该病例中患者未诉食物嵌塞症状，故不需调（牙合）。全冠修复（E错）应在患牙完成牙髓治疗后，根据余留牙体组织量、（牙合）龈距大小、邻牙和对颌牙的情况等来综合评估是否需要全冠修复，或者采取其他修复方式，这是属于患牙的修复治疗，不是目前的处理原则。